男，36岁。3年内抽搐发作20余次。发作表现为无诱因的口角和右上肢抽搐，意识尚清，但不能对答，约5～10秒后意识丧失伴全身抽搐。持续30秒后，逐渐停止。事后不能回忆发作过程。发作间期的神经系统检查和常规脑电图检查未见异常。针对该患者的治疗首选药物是
A. 氯硝西泮
B. 苯妥英钠
C. 苯巴比妥
D. 乙琥胺
E. 卡马西平

正确答案：E。卡马西平

解析：患者为成年男性，抽搐发作表现为无诱因的口角和右上肢抽搐（部分运动性发作），意识尚清，约5～10秒后意识丧失伴全身抽搐（意识障碍并继发全身发作），持续30秒后，逐渐停止（部分性发作的持续时间一般＜1分钟），结合以上病史、临床表现，最有可能的诊断为部分性继发全面性发作。卡马西平（E对）是部分性发作的首选药物，对复杂部分性发作疗效优于其他抗癫痫药，对继发性GTCS亦有较好的疗效。苯妥英钠（B错）是常用的抗癫痫药物。苯巴比妥（C错）为小儿癫痫的首选药物。乙琥胺（D错）仅用于单纯失神发作。氯硝西泮（A错）起效快，但易出现耐药使作用下降，可作为辅助用药。